属于增白牙膏成分的是
A. 洗必泰
B. 单氟磷酸钠
C. 氯化钾
D. 三氯羟苯醚
E. 氧化剂

正确答案：E。氧化剂

解析：目前针对内源性着色的牙膏中添加了主要是过氧化物的成分，如过氧化氢或过氧化脲等，这些产品需要在临床医生指导下使用。掌握“自我口腔保健方法”知识点。